男，50岁，黑便，头晕，血压90/60mmHg，输悬浮红细胞后出现呼吸困难，胸闷。最可能的诊断是
A. 过敏反应
B. 输血后正常反应
C. 急性溶血反应
D. 急性肺损伤
E. 急性肾损伤

正确答案：C。急性溶血反应

解析：患者黑便，头晕，血压偏低（血压低于90/60mmHg时称低血压），提示消化道出血引发失血性休克。输血后出现呼吸困难和胸闷，最可能的诊断是急性溶血反应（C对）。急性溶血反应是由于输注异型血导致的，表现为输注少量异型血后立即出现呼吸困难、胸闷、血压下降、休克等症状。需注意：一般题中“输血后出现”即等同于“输血后立即出现”。输血后的过敏反应最典型的表现为皮肤局限性或全身性的瘙痒或荨麻疹，严重者可出现呼吸困难、休克等（A错）。正常输血后应无任何明显症状（B错）。急性肺损伤（P23）也可出现呼吸困难、胸闷、低血压等症状，但其发病机制为供血者血浆中存在白细胞凝集素或HLA（人类白细胞抗原）特异性抗体所致，该患者输注的为悬浮红细胞，去除了大部分血浆，一般不会引发急性肺损伤（D错）。急性肾损伤是指由多种病因引起的肾功能快速下降而出现的临床综合征，表现为氮质血症、水电解质和酸碱平衡紊乱（E错）。